因口底血肿引起窒息时，急救的最合理方法是
A. 托下颌角使下颌骨前移
B. 安置口咽通气管道
C. 血肿切开引流
D. 肌注血药
E. 将舌牵至口外

正确答案：E。将舌牵至口外

解析：本题考查窒息的急救处理。因口底血肿引起窒息时，急救的最合理方法是将舌牵至口外（E对）。托下颌角使下颌骨前移不能解除因口底血肿引起的窒息（A错）。口底血肿是由于种种外力作用，导致血管破裂、溢出的血液分离周围组织，形成充满血液的腔洞。口底血肿可使舌抬高堵塞上呼吸道，首先应将舌牵出口外，缓解窒息。安置口咽通气管道为有创操作，将舌牵拉至口外为无创操作，如无创操作可以解除窒息，不必行有创操作（B错）。窒息状态，如立即行血肿切开，血液可流入呼吸道加重窒息（C错）。肌注血药起效缓慢（D错）。